浓度为1ppm的铅溶液的含量是
A. 表示十分之一
B. 表示百分之一
C. 表示千分之一
D. 表示十万分之一
E. 表示百万分之一

正确答案：E。表示百万分之一

解析：本题考查药物浓度表示方法。1ppm表示百万分之一（E对）。